菌落总数可作为食品
A. 污染粪便的标志
B. 腐败变质的标志
C. 酸败的标志
D. 清洁状态的标志
E. 质量的标志

正确答案：D。清洁状态的标志

解析：本题考查菌落总数。菌落总数是指在被检样品的单位质量（g）、容积（ml）内，在严格规定的条件下（培养基及其pH、培育温度与时间、计数方法等）培养所形成的细菌菌落总数，以菌落形成单位（CFU）表示。菌落总数的卫生学意义包括两方面：一是作为食品被细菌污染程度即清洁状态的标志（D对ABCE错）；二是可用于预测食品的耐保藏性。